男，28岁，3年来反复乏力、纳差、肝区隐痛，血清转氨酶反复升高，胆红素偏高，血清球蛋白升高，类风湿因子阳性。体检：面色灰暗肝掌及蜘蛛痣，肝右肋下2cm质地中等，脾肋下0.5cm。对此病例的诊断应是
A. 慢性迁延性肝炎
B. 慢性活动性肝炎
C. 慢性重型肝炎
D. 胆道感染
E. 类风湿关节炎

正确答案：B。慢性活动性肝炎

解析：出现蜘蛛痣肝掌就是——活动性 出现凝血酶活动度降低就是——重症性 慢性迁延性——就是个慢性肝炎 较轻。慢性迁延性肝炎是指病程超过半年，仍然迁延不愈，症状、体征和肝功能异常较轻，病人经常出现轻度乏力、肝区痛、食欲差、腹胀等，亦可无明显症状。常伴有肝脏稍大，脾脏有时亦可肿大。一般无黄疸，转氨酶持续或间歇升高，血浆白蛋白与球蛋白数值基本正常（A错）。慢性活动性肝炎主要表现为食欲差、乏力、恶心呕吐、肝脏肿大、脾大，反复发作性黄疸，面色较灰暗、前胸可见有蜘蛛痣或肝掌、检查谷丙转氨酶反复或持续性升高、多伴有蛋白代谢异常、血浆白蛋白降低、白蛋白/球蛋白比例降低或倒置，此型肝炎与题干相符（B对）。慢性重型肝炎起病时的临床表现同亚急性重型肝炎， 随着病情发展而加重， 达到重型肝炎诊断标准（ 凝血酶原活动度低于40%， 血清总胆红素大于正常10 倍） （C错）。胆道感染包括急性胆囊炎、慢性胆囊炎、慢性结石性胆囊炎、急性胆管炎、慢性胆管炎、原发性胆管结石症、急性梗阻性化脓性胆管炎（D错）。类风湿性关节炎是一种病因未明的慢性、以炎性滑膜炎为主的系统性疾病。其特征是手、足小关节的多关节、对称性、侵袭性关节炎症，经常伴有关节外器官受累及血清类风湿因子阳性，可以导致关节畸形及功能丧失（E错）。